某男，34岁。胃痛隐隐，绵绵不休，喜温喜按，劳累，受凉或空腹时疼痛明显，进食后疼痛缓解，时呕清水，神疲纳少，四肢倦怠，手足不温，大便溏薄，舌淡苔白，脉虚弱。医师诊断为胃痛，证属脾胃虚寒，处方如下：炙黄芪9g，桂枝9g，白芍18g，生姜6g，炙甘草9g；大枣6g，饴糖10g，7剂水煎服每日1剂早、午、晚分服。患者欲改服中成药巩固治疗，根据辨证结果，不宜选用的中成药是
A. 黄芪健胃膏
B. 胃疡灵颗粒
C. 胃乐新颗粒
D. 虚寒胃痛胶囊
E. 温胃舒胶囊

正确答案：C。胃乐新颗粒

解析：本题考查的是胃痛的辨证论治。胃痛隐隐，绵绵不休，喜温喜按，劳累，受凉或空腹时疼痛明显，进食后疼痛缓解，时呕清水，神疲纳少，四肢倦怠，手足不温，大便溏薄，舌淡苔白，脉虚弱。医师诊断为胃痛，证属脾胃虚寒，处方如下：炙黄芪9g，桂枝9g，白芍18g，生姜6g，炙甘草9g；大枣6g，饴糖10g，7剂水煎服每日1剂早、午、晚分服。患者欲改服中成药巩固治疗，根据辨证结果，不宜选用的中成药是胃乐新颗粒（C错，为本题正确答案）。胃痛脾胃虚寒证：【症状】胃痛隐隐，绵绵不休，喜温喜按，空腹痛甚，得食痛缓，劳累或受凉后发作或加重，时呕清水，神疲纳少，四肢倦怠，手足不温，大便溏薄。舌淡苔白，脉虚弱或迟缓。【中成药应用】常用中成药有黄芪健胃膏（A对）、温胃舒胶囊（E对）、胃疡灵颗粒（B对）、虚寒胃痛胶囊（D对）。胃乐新颗粒为胃痛胃阴亏耗证的中成药应用。胃痛胃阴亏耗证：【症状】胃脘隐隐灼痛，似饥而不欲食，口干咽燥，口渴思饮，五心烦热，消瘦乏力，大便干结。舌红少津，脉细数。【中成药应用】常用中成药有胃尔康片、胃乐新颗粒、胃安胶囊、阴虚胃痛颗粒。